女，25岁，初产妇，妊娠39周，规律宫缩8小时，无头盆不称，胎心148次/分，宫口开大3cm，S+1，目前应做的是
A. 人工破膜
B. 静推地西泮
C. 静滴硫酸镁
D. 静滴缩宫素
E. 继续观察产程进展

正确答案：E。继续观察产程进展

解析：年轻产妇，规律宫缩8小时（正常初产妇＜20h），宫口开大3cm（＜10cm），S+1，无不适，处于第一产程，继续观察产程进展（E对）即可。第一产程潜伏期延长者，可静推地西泮（B错）、哌替啶等镇静剂，起到良好的镇静，软化宫颈，协调子宫收缩的作用；若用镇静剂后宫缩无改善，可给予缩宫素静滴。宫颈口开大3cm而2～4小时后宫颈扩张无进展，应给予人工破膜（A错）和静滴缩宫素（D错）加强产力，以促进产程进展。